结构上为甾体激素
A. 氢化可的松
B. 苯丙酸诺龙
C. 两者均是
D. 两者均不是

正确答案：C。两者均是

解析：本题考查药物结构。结构上为甾体激素的药物为氢化可的松和苯丙酸诺龙（C对）。氢化可的松为肾上腺皮质类激素，是一种甾体激素。苯丙酸诺龙为临床常用的蛋白同化类激素。蛋白同化激素，是一类拟雄性激素的人工合成的甾体激素。